用药后应保持上身直立的药物是
A. 阿仑膦酸钠
B. 去氨加压素
C. 硫酸亚铁
D. 阿莫西林
E. 辛伐他汀

正确答案：A。阿仑膦酸钠

解析：本题考查骨质疏松症的药物治疗。用药后应保持上身直立的药物是阿仑膦酸钠（A对）。去氨加压素（B错）主要用于治疗大出血或侵入性手术前预防大出血、中枢性尿崩症、夜间遗尿等。硫酸亚铁（C错）主要用于缺铁性贫血。阿莫西林（D错）为广谱青霉素，用于敏感菌所致的感染。辛伐他汀（E错）为羟甲戊二酰辅酶A还原酶抑制剂，用于高脂血症。